输入大量库存过久的血液易导致
A. 高钠血症
B. 低钠血症
C. 低钾血症
D. 高钾血症
E. 低镁血症

正确答案：D。高钾血症

解析：输入大量库存过久的血液，库存血中红细胞内的钾离子大量进入红细胞外的血浆中，引起高钾血症（D对C错）。